胃网膜右动脉发自
A. 腹腔干
B. 肝总动脉
C. 肝固有动脉
D. 脾动脉
E. 胃十二指肠动脉

正确答案：E。胃十二指肠动脉

解析：胃十二指肠动脉（E对）的分支为胃网膜右动脉和胰十二指肠上动脉。